55岁农民，稻田劳动后右小腿肿痛4天，体温38.8℃，见皮疹，4✕4cm，色鲜红，中间颜色淡，界限清楚，错误的治疗是
A. 红肿切开引流
B. 抗生素治疗
C. 硫酸镁湿敷
D. 抬高患侧肢体
E. 卧床休息

正确答案：A。红肿切开引流

解析：患者劳动后发热、左小腿肿痛（丹毒好发于下肢与面部），见皮肤红疹，色鲜红，中间稍淡，边界清楚，根据临床表现最可能的诊断为丹毒。治疗丹毒时，注意卧床休息（E对），抬高患肢（D对）。局部可用50%硫酸镁液湿敷（C对）。全身应用抗菌药物（B对），如静脉滴注青霉素、头孢菌素类敏感抗生素。切开引流（A错，为本题正确答案）是脓肿的首要处理方式，并不适用于丹毒急性期。